以下符合病毒性心肌炎的是
A. 患者血压明显升高，体检：血压200/130mmHg（266/169kP），眼底出血渗出视乳头水肿，实验室报告：肾功能不全
B. 患者血压明显升高，伴有剧烈头痛呕吐抽搐
C. 患者平日有心悸胸痛劳力时气促起立或运动时眩晕，体检：胸骨左缘第3～4肋间可闻较粗糙的喷射性收缩期杂音，屏气时杂音增强
D. 患者一周前出现发热，全身无力，现自觉心悸胸闷，体检：心率120次/分，偶闻室性早搏，实验室回报CPK、GOT（AST）、LDH增高
E. 患者气急，端坐呼吸，体检：心脏扩大，听诊可闻及第四心音奔马律，双下肢浮肿，超声心动图报告：左心室腔明显扩大

正确答案：D。患者一周前出现发热，全身无力，现自觉心悸胸闷，体检：心率120次/分，偶闻室性早搏，实验室回报CPK、GOT（AST）、LDH增高

解析：病毒性心肌炎多数患者发病前1～3周有病毒感染前驱症状，如发热、全身无力，随后可以有心悸，胸闷、胸痛、呼吸困难，甚至晕厥、猝死，查体常有心律失常，以房性与室性早搏及房室传导阻滞最为多见，心肌损伤标志物检查可有心肌肌酸激酶（CK-MB）、肌钙蛋白（T或I）、GOT（AST）及LDH增高（D对）。患者血压明显升高，体检：血压200/130mmHg（26.6/16.9kPa），眼底出血渗出视乳头水肿，实验室报告：肾功能不全符合恶性高血压临床表现（A错）。血压明显升高，伴有剧烈头痛呕吐抽搐符合高血压急症临床表现（B错）。患者平日有心悸、胸痛、劳力时气促、起立或运动时眩晕，体检：胸骨左缘第3～4肋间可闻较粗糙的喷射性收缩期杂音，屏气时杂音增强符合肥厚型心肌病的特点（C错）。患者气急，端坐呼吸，体检：心脏扩大，听诊可闻及第四心音奔马律，双下肢浮肿，超声心动图报告：左心室腔明显扩大符合扩张型心肌病的特点（E错）。